据《素问·上古天真论》，女子二七的生理特点是
A. 任脉虚，太冲脉衰少
B. 肾气盛，齿更发长
C. 阳明脉衰，面始焦
D. 天癸至，任脉通，太冲脉盛
E. 筋骨坚，发长极

正确答案：D。天癸至，任脉通，太冲脉盛

解析：女子十四岁时，天癸产生，任脉通畅，太冲脉旺盛，月经按时来潮，具备了生育子女的能力（D对）；女子四十九岁时，任脉气血虚弱，太冲脉的气血衰少，天葵枯竭，月经断绝，所以形体衰老，失去了生育能力（A错）；女子七岁，肾气盛旺了起来，乳齿更换，头发开始茂盛（B错）；女子三十五岁时，阳明经脉气血渐衰弱，面部开始憔悴，头发也开始脱落（C错）；女子十四岁时，天癸产生，任脉通畅，太冲脉旺盛，月经按时来潮，具备了生育子女的能力（D错）；女子二十八岁时，筋骨强健有力，头发的生长达到最茂盛的阶段，此时身体最为强壮（E错）。